男性，47岁。因上65|缺失。进行上颌：7654|固定义齿修复。1年后基牙有咬合痛、松动。其主要原因为
A. 末端侧下沉
B. 咬合早接触
C. 设计不合理
D. 固位力不够
E. 基牙数目少

正确答案：C。设计不合理

解析：固定桥设计适合于固定桥基牙的牙周膜面积大于缺失牙牙周膜面积，且不适用于远中游离缺失的修复，此患者上65|缺失，进行上颌7654|固定义齿修复，上74|的牙周膜面积之和小于上65|的牙周膜面积之和，造成基牙的疼痛和松动。掌握“固定桥修复后出现的问题及处理”知识点。